患者，女，58岁，诊断为骨性关节炎，经洛索洛芬单药治疗，疼痛缓解不理想。可联合使用的药物是
A. 双氯芬酸
B. 美洛昔康
C. 阿司匹林
D. 曲马多
E. 布洛芬

正确答案：D。曲马多

解析：本题考查曲马多。经洛索洛芬单药治疗疼痛缓解不理想可联合使用的药物是曲马多（D对）。双氯芬酸（A错）为非选择性NSAIDs，用于各种急、慢性关节炎和软组织风湿所致的疼痛，以及创伤后、术后的疼痛、牙痛、头痛等，对成年人及儿童的发热有解热作用。使用时应注意消化道损害、肾损害及高血压，缓释剂型不可嚼碎服用。美洛昔康（B错）为选择性较高的COX-2抑制剂，在发挥抗炎作用的同时，胃肠道不良反应较小，用于类风湿关节炎的症状治疗、疼痛性骨关节炎（关节病、退行性骨关节病）的症状治疗。阿司匹林（C错）为环氧合酶（COX）的不可逆抑制剂，可以使COX发生乙酰化反应而失去活性，从而阻断前列腺素等内源性致热致炎物质的生物合成，起到解热、镇痛、抗炎的作用，另外还可以抑制血小板凝聚和防止血栓形成。由于对COX酶缺乏选择性，抑制了胃壁处的COX-1，造成胃壁处前列腺素合成减少，胃黏膜失去保护作用，引起消化道溃疡、出血等不良反应。布洛芬（E错）为非选择性NSAIDs，具有抗炎、镇痛、解热作用，适用于治疗风湿性关节炎、类风湿关节炎、骨关节炎、强直性脊柱炎和神经炎等。不良反应最常见于胃肠系统，其发生率高达30%，从腹部不适到严重的出血或使消化性溃疡复发。